减压病引起的栓塞为
A. 气体栓塞
B. 血栓栓塞
C. 羊水栓塞
D. 脂肪栓塞
E. 异物栓塞

正确答案：A。气体栓塞

解析：减压病是指人体从高气压环境迅速进入常压或低气压环境时，原来溶于血液、组织液和脂肪组织的气体（包括O₂、CO₂和N₂）迅速游离形成气泡，O₂和CO₂可再溶于体液内被吸收，但N₂在体液内溶解缓慢，故可在血液和组织内形成很多微气泡或大气泡，引起气体栓塞（A对）。血栓栓塞（P55）（B错）主要由来自动、静脉及心腔的栓子引起。羊水栓塞（C错）主要由分娩过程中，进入血液循环的羊水引起。脂肪栓塞（D错）主要由长骨骨折、脂肪组织挫伤等引起。异物栓塞（P57）（E错）主要由进入血液循环的异物引起。